与阿司匹林合用会促进前房出血的是
A. 甘草
B. 银杏
C. 烟草
D. 人参
E. 苦瓜

正确答案：B。银杏